女婴，出生7天。母亲代诉患儿烦躁不安、啼哭，拒绝进食。口腔检查见左颊部及舌尖部有散在分布的雪白色柔软小斑点，基底黏膜充血明显。稍用力可擦去，留下出血的糜烂面。初步诊断为
A. 急性假膜型念珠菌口炎
B. 急性红斑型念珠菌口炎
C. 慢性肥厚型念珠菌口炎
D. 慢性红斑型念珠菌口炎
E. 念珠菌性唇炎

正确答案：A。急性假膜型念珠菌口炎

解析：本题考查口腔念珠菌病。女婴，出生7天。母亲代诉患儿烦躁不安、啼哭，拒绝进食。口腔检查见左颊部及舌尖部有散在分布的雪白色柔软小斑点，基底黏膜充血明显。稍用力可擦去，留下出血的糜烂面。初步诊断为急性假膜型念珠菌口炎（A对）。该患儿出生7天，左颊部及舌尖部有软白小斑点，烦躁不安、啼哭拒食，基底黏膜充血明显，擦去斑点后暴露出血糜烂面，患儿的临床表现符合急性假膜型念珠菌口炎（新生儿鹅口疮）的临床特点。急性红斑型念珠菌口炎（B错）可原发或继发于假膜型，临床表现为黏膜上出现外形弥散的红斑，以舌黏膜多见，严重时舌背黏膜呈鲜红色并有舌乳头萎缩，双颊、上腭及口角也可有红色斑块。慢性肥厚型念珠菌口炎（C错）可有角化不全、棘层增厚、上皮增生、微脓肿形成，颊黏膜病损常对称位于口角内侧三角区，呈结节状或颗粒状增生，或为固着紧密的白色角质斑块。慢性红斑型念珠菌口炎（D错）损害部位常在上颌义齿腭侧面接触之腭、龈黏膜，黏膜呈亮红色水肿，或有黄白色的条索状或斑点状假膜。念珠菌性唇炎（E错）多发于高龄（50岁以上）患者，一般发生于下唇，糜烂型者在下唇中份长期存在鲜红糜烂面，周围有过角化现象，表面脱屑；颗粒型者表现为下唇肿胀，唇红皮肤交界处常有散在突出的小颗粒。